婴儿腹泻重型与轻型的主要区别是
A. 发热、呕吐
B. 每日大便超过10次
C. 有水、电解质紊乱
D. 大便含黏液、腥臭
E. 镜检有大量脂肪滴

正确答案：C。有水、电解质紊乱

解析：小儿腹泻病，是一组由多种病原、多因素引起的消化道疾病，临床以大便次数增多和大便性状改变为特点，轻型腹泻以胃肠道症状为主，表现为大便次数增多，每日数次至数十次，多为黄色水样或蛋花样大便，含有少量黏液，少数患儿也可有少量血便，食欲低下，常有呕吐，严重者可吐咖啡色液体，重型腹泻除有较重的胃肠道症状外，常有较明显的脱水、电解质紊乱和全身中毒症状（C对）。发热、呕吐（A错）、每日大便超过10次（B错）、大便含黏液、腥臭（D错）均属于胃肠道症状，婴儿腹泻重型与轻型临床均可出现。镜检有大量脂肪滴（E错）为脂肪泻的临床表现。